下列属于社区卫生服务对象的是
A. 健康人群
B. 亚健康人群
C. 重点保健人群
D. 病人
E. 以上都是

正确答案：E。以上都是

解析：本题考查社区卫生服务的对象。社区卫生服务的对象包括：①健康人群；②高危人群；③重点保健人群；④病人。本题中四个人群均属于（E对ABCD错）社区卫生服务的对象。